靴形心脏常见于
A. 主动脉瓣关闭不全
B. 肺动脉瓣关闭不全
C. 二尖瓣狭窄
D. 二尖瓣关闭不全
E. 三尖瓣狭窄

正确答案：A。主动脉瓣关闭不全

解析：靴形心脏常见于主动脉关闭不全（A对），形成原因是左心室增大，心浊音界向左下增大，心腰加深。肺动脉瓣关闭不全（B错）主要导致右心室增大。二尖瓣狭窄（C错）主要导致左心房增大或合并肺动脉段扩大，形成“梨形心”。二尖瓣关闭不全（D对）主要导致左心房增大。三尖瓣狭窄（E错）主要导致右心房明显扩大。